男，50岁。乙型肝炎病史10年。近3个月肝区胀痛不适，CT检査：肝右叶5cm占位性病变。为进一步明确性质应首选检测
A. CA19-9
B. 甲胎蛋白
C. 癌胚抗原
D. CA15-3
E. 碱性磷酸酶

正确答案：B。甲胎蛋白

解析：患者50岁，乙肝病史10年，肝区胀痛，肝右叶占位性病变，高度怀疑其为原发性肝癌。甲胎蛋白（AFP）（B对）是肝癌的肿瘤标记物，当AFP≥400ug/L时，结合影像学检查可确定诊断。CA19-9（A错）胰腺癌的首选肿瘤标志物。癌胚抗原（C错）是一种广谱性肿瘤标志物，可在多种肿瘤中表达，脏器特异性低。CA15-3（D错）主要用于乳腺癌患者的治疗监测和预后判断。碱性磷酸酶（E错）广泛分布于人体组织和体液，大部分由骨细胞产生，是恶性骨肿瘤的肿瘤标志物。